可长期保存病毒的因素是
A. 干扰素
B. 乙醚
C. 青霉素
D. ﹣70℃
E. 紫外线

正确答案：D。﹣70℃